测定左氧氟沙星比旋度应选用的仪器是
A. 酸度计
B. 旋光计
C. 紫外-可见分光光度计
D. 温度计
E. 红外分光光度计

正确答案：B。旋光计

解析：本题考查旋光计。旋光计（B对）测定比旋度值可用来鉴别药物或判断药物的纯杂程度。在规定的条件下，物质的比旋度是定值。如左氧氟沙星、肾上腺素、硫酸奎宁、葡萄糖、阿莫西林、氢化可的松。